皮质核束经过
A. 内囊前肢
B. 内囊后肢
C. 内囊膝
D. 听辐射
E. 无

正确答案：C。内囊膝

解析：内囊前肢（A错）的投射纤维主要包括额桥束和丘脑前辐射；内囊膝部（C对）的投射纤维有皮质核束； 内囊后肢（B错）的投射纤维有皮质脊髓束、皮质红核束和顶桥束；听辐射（D错）经内囊后肢，止于大脑皮质。